何者错误
A. III、IV、VI脑神经穿过其内或经其外侧壁
B. 有颈内动脉通过
C. 有视神经通过
D. 经眼静脉与面静脉相通
E. 与翼静脉丛相通

正确答案：C。有视神经通过

解析：海绵窦窦腔内侧壁有颈内动脉（B对）通过，动眼神经（第III对脑神经）、滑车神经（第IV对脑神经）、展神经（第VI对脑神经）也穿过海绵窦的内或外侧壁（A对），视神经不穿过海绵窦的任何一侧壁（C错，为本题正确答案）。除此之外，海绵窦与周围的静脉有广泛的交通和联系，向前经眼静脉与面静脉相通（D对），向下经卵圆孔的小静脉与翼静脉丛相通（E对）。